2个月男婴，完全母乳喂养，无前驱症状突然出现面色苍白，前囟隆起，双眼凝视，肌内注射部位出血不止，高度怀疑诊断为
A. 脑膜炎
B. 维生素K缺乏症
C. 血友病
D. 铁缺乏症
E. 钙缺乏症

正确答案：B。维生素K缺乏症

解析：本题考查人乳营养成分缺失的相关内容。乳类含维生素K较少，人乳中维生素K含量仅为牛乳中含量的1/4，且母乳喂养婴儿肠道内细菌合成维生素K较少。因此，单纯母乳喂养未添加辅食的幼儿易患维生素K缺乏症（B对ACDE错）。临床表现为广泛出血倾向，常合并急性颅内出血，多见于3个月以内的婴儿，常突然出现自发性出血，常见注射部位出血不止，严重者发生颅内出血，危及生命。